影响种植体骨结合的因素中，可除外的是
A. 种植体材料的生物相容性
B. 病人自身条件
C. 手术创伤
D. 种植体应力分布的合理性
E. 术前是否应用抗生素

正确答案：E。术前是否应用抗生素

解析：影响种植体骨结合的因素①手术创伤种植手术时，由下钻孔时产热，可使周围已分化和未分化的间叶细胞坏死。因此，手术中对骨组织的活力的保护十分重要，手术者应操作精巧，使用锐利的切削工具，严格控制产热和散热。②患者自身条件包括患者全身及局部的健康状况、牙槽突的质量和形态以及口腔卫生习惯等。③种植体材料的生物相容性此点对骨结合的形成十分重要。④种植体外形设计包括种植体的自身强度、与骨组织最大的结合面积、应力的合理分布、缓冲装置以及其表面不应有锐角等。⑤种植体的应力分布：种植体植入的部位、数量和方向，骨结合后义齿的修复处理，直接影响应力的分布。⑥种植体的早期负载：种植体植入后，应保证足够的骨愈合过程，待骨结合完成以后再作修复治疗。掌握“牙种植术概论”知识点。